股骨干下1/3骨折的典型移位是
A. 骨折远端向前移位
B. 骨折端向前成角移位
C. 骨折远端向后移位
D. 骨折远端向内移位
E. 骨折近端向侧方移位

正确答案：C。骨折远端向后移位

解析：上1/3  近：向前、外及外旋移位；远：向内、后移位；中1/3  向外成角；下1/3  近：向前移位；远：向后移位（C对）。